分消走泄法的代表方是
A. 雷氏芳香化浊法
B. 蒿芩清胆汤
C. 藿朴夏苓汤
D. 王氏连朴饮
E. 三仁汤

正确答案：E。三仁汤

解析：分消走泄法为用辛开苦泄之品宣展气机，清化三焦气分痰热或湿热。适用于邪留三焦，气化失司，所致痰热、湿浊阻滞之证。症见寒热起伏，汗出不解，胸痞腹胀，溲短，苔腻等。代表方如三仁汤（E对）、温胆汤加减，或以叶天士所说的杏、朴、苓之类为基本药。